男性，22岁，上腹突发刀割样剧痛2小时，全腹压痛，反跳痛，以剑突下为著，肌紧张呈木板状，肠音消失，治疗原则中应不包括
A. 早期注射抗生素
B. 禁食，胃肠减压
C. 术后必须腹腔内放引流条
D. 确诊后可用止痛剂
E. 清除引起腹膜炎的病因

正确答案：C。术后必须腹腔内放引流条

解析：青年男性患者，上腹突发刀割样剧痛2小时，全腹压痛，反跳痛（消化道穿孔的典型临床表现），以剑突下为著，肌紧张呈木板状，肠音消失（消化道穿孔的典型体征），根据临床症状及体征，考虑诊断为消化道穿孔，治疗方法包括早期注射抗生素（A对）；禁食，胃肠减压（B对）；镇静止痛吸氧（D对）等非手术治疗方法。 手术开腹后立即用吸引器吸净腹腔内的脓液及渗出液，清除食物残渣、粪便和异物等，从而清除引起腹膜炎的病因（E对）。术后是否要放引流条应视情况而定，而非必须（C错，为本题正确答案）。